天柱穴位于
A. 当翳风与风池穴连线的中点
B. 乳突前下方与下颌角之间的凹陷中
C. 胸锁乳突肌与斜方肌上端之间的凹陷中
D. 后发际正中直上0.5寸，旁开1.3寸，当斜方肌外缘凹陷中
E. 耳后，乳突后下凹陷处

正确答案：D。后发际正中直上0.5寸，旁开1.3寸，当斜方肌外缘凹陷中

解析：当翳风与风池穴连线的中点为安眠穴（A错）。乳突前下方与下颌角之间的凹陷中为翳风穴（B错）。胸锁乳突肌与斜方肌上端之间的凹陷中为风池穴（C错）。后发际正中直上0.5寸，旁开1.3寸，当斜方肌外缘凹陷中为天柱穴（D对）。耳后，乳突后下凹陷处为完骨穴（E错）。